患者肢体关节疼痛较剧，痛有定处，得热痛减，遇寒痛增，疼痛局部皮色不红，触之不热，舌苔薄白，脉弦紧。治疗应首选
A. 独活寄生汤
B. 蠲痹汤
C. 薏苡仁汤
D. 乌头汤
E. 白虎加桂枝汤

正确答案：D。乌头汤

解析：患者以肢体关节疼痛较剧为主症，故诊断为痹证；风寒湿邪闭阻经络，而以寒邪偏盛，其性凝滞，故肢体关节疼痛较剧，痛有定处；得热则气血较为流畅，故得热痛减；遇寒则血益凝滞，故遇寒痛增；寒属阴邪，故疼痛局部皮色不红，触之不热；舌苔薄白，脉弦紧，为属痛属寒之征，故其证候为痛痹证，治以散寒通络，祛风除湿，代表方为乌头汤（D对）。独活寄生汤，其功用为培补肝肾，舒筋止痛（A错）。蠲痹汤，其功用为益气和营，祛风胜湿，通络止痛，适用于久痹之风、寒、湿偏盛不明显者(B错)。薏苡仁汤，其功用为健脾祛湿，发散风寒，可用于治疗着痹证（C错）。白虎加桂枝汤，其功用为清热宣痹，与宣痹汤合用，可用于治疗风湿热痹证（E错）。